来源于T淋巴细胞的淋巴瘤类型是
A. 滤泡性淋巴瘤
B. 套细胞淋巴瘤
C. 边缘区淋巴瘤
D. 毛细胞白血病
E. 蕈样霉菌病

正确答案：E。蕈样霉菌病

解析：常见的T细胞淋巴瘤有间变性大细胞淋巴瘤、原发性皮肤间变性大细胞淋巴瘤、蕈样霉菌病、Sezary综合征、扭曲性淋巴细胞淋巴瘤等（记忆为“大S”）。滤泡性淋巴瘤（A错）、套细胞淋巴瘤（B错）、边缘区淋巴瘤（C错）、毛细胞白血病（D错）均属于B细胞淋巴瘤。